属于相反配伍关系的药组是
A. 黄芪配茯苓
B. 石膏配知母
C. 生姜配半夏
D. 人参配莱菔子
E. 乌头配川贝母

正确答案：E。乌头配川贝母

解析：本题考查中药的配伍及应用原则。属于相反配伍关系的药组是乌头配川贝母（E对）。相反：即两种药物合用，能产生或增强毒害反应。如乌头反半夏、甘草反甘遂等。相使：即性能功效有某种共性的两药同用，一药为主，一药为辅，辅药能增强主药的疗效。如以补气利水的黄芪为主，配以利水健脾的茯苓（A错）为辅，茯苓能增强黄芪的补气利水效果等。相须：即性能相类似的药物合用，可增强原有疗效。如石膏配知母（B错）可增强清热泻火效果等。相杀：即一种药物能减轻或消除另一种药物的毒烈之性。如生姜能减轻或消除生半夏的毒性，故云生姜杀半夏（C错）。相恶：即两药合用，一种药物能使另一种药物原有功效降低，甚至丧失。如人参恶莱菔子（D错），因莱菔子能削弱人参的补气作用。